嵌顿性肩先露通常不易引起
A. 病理缩复环
B. 宫腔内感染
C. 脐带脱垂
D. 胎盘早剥
E. 胎死宫内

正确答案：D。胎盘早剥

解析：嵌顿性肩先露使子宫收缩继续增强，子宫上段越来越厚，子宫下段被动扩张越来越薄，由于子宫上下段肌壁厚薄相差悬殊，形成环状凹陷，并随宫缩逐渐升高，甚至可以高达脐上，形成病理缩复环（A对）。胎膜破裂羊水外流容易使脐带脱垂（C对），脐带脱垂导致胎儿窘迫，以致于胎死宫内（E对）。其中嵌顿性肩先露对宫颈口及子宫下段贴合不均匀，常发生胎膜早破，容易导致宫腔内感染（B对）。胎盘早剥的病因主要有血管因素（妊娠期高血压疾病）、机械性损伤和宫腔内压力骤减等（D错，为本题正确答案）。